以下哪项不是学校/儿童少年卫生学的研究内容
A. 生长发育
B. 疾病防治
C. 心理卫生
D. 教育过程卫生
E. 职业生理

正确答案：E。职业生理